肝病传脾属于
A. 相侮传变
B. 制化传变
C. 母病及子
D. 相乘传变
E. 子病犯母

正确答案：D。相乘传变

解析：五行之中，肝属木，脾属土。肝病传脾体现了木克土，属于一行对其所胜行的过度制约克制，为相乘传变（D对）。在相侮传变是指五行中一行对其所不胜的反向制约和克制，土侮木（A错）。制化传变指五行之间逆相生化，又逆相制约，生化中有制约，制约中有生化，二者相辅相成，从而维持其相对平衡和正常的协调关系（B错）。肝其母为肾，其子为心；脾其母为心，其子为肺。与母病及子、子病犯母均无关（CE错）。